以下学科中的工作模式为“健康生态模型”的是
A. 口腔流行病学
B. 临床综合内科学
C. 传染病学
D. 预防医学
E. 医学心理学

正确答案：D。预防医学

解析：预防医学是医学的一门应用学科，它以个体和确定的群体为对象，目的是保护、促进和维护健康，预防疾病、失能和早逝。其工作模式是“健康生态学模型”。掌握“预防医学概论、健康及三级预防策略”知识点。